治疗甲状腺功能亢进症气滞痰凝证，应首选
A. 逍遥散合二陈汤
B. 龙胆泻肝汤
C. 天王补心丹
D. 生脉散
E. 知柏地黄丸

正确答案：A。逍遥散合二陈汤

解析：甲状腺功能亢进气滞痰凝证其机理为气机壅滞，痰浊阻于颈部，故治宜疏肝理气，化痰散结，方选疏肝理气，健脾养血的逍遥散合理气化痰散结的二陈汤加减（A对）。龙胆泻肝汤加减（B错）可用来清肝泻火，消瘿散结，用于治疗甲状腺功能亢进症肝火旺盛证；天王补心丹加减（C错）可以滋阴降火，消瘿散结，用于治疗甲状腺功能亢进症阴虚火旺证；生脉散加味（D错）可以益气养阴，消瘿散结，用于治疗甲状腺功能亢进症气阴两虚证。知柏地黄丸（E错）可用于滋肾阴，降虚火，治疗阴虚火旺证。